PCBs在人体中主要蓄积于
A. 脑组织
B. 脂肪组织
C. 皮肤组织
D. 软骨组织
E. 肝脏

正确答案：B。脂肪组织

解析：本题考查PCBs在人体中的主要蓄积部位。PCBs（多氯联苯）是一类有毒的有机物，它可以通过空气、水和土壤进入人体，并可能会影响人体健康。PCBs在人体中的蓄积主要取决于其被吸收的速率和排出的速率，它们主要蓄积在脂肪组织（B对ACDE错）中。